茎圆柱形，表面黄绿或棕黄色，具纵棱线，断面中部有白色的髓，叶互生的药材是
A. 槲寄生
B. 荆芥
C. 青蒿
D. 益母草
E. 金钱草

正确答案：C。青蒿

解析：本题考查的是青蒿药材的性状鉴别。茎圆柱形，表面黄绿或棕黄色，具纵棱线，断面中部有白色的髓，叶互生的药材是青蒿（C对）。青蒿：【性状鉴别】药材茎呈圆柱形，上部多分枝；表面黄绿色或棕黄色，具纵棱线；质略硬，易折断，断面中部有髓。叶互生，暗绿色或棕绿色，卷缩易碎，完整者展平后为三回羽状深裂，裂片及小裂片矩圆形或长椭圆形，两面被短毛。气香特异，味微苦。槲寄生（A错）：【性状鉴别】药材茎枝呈圆柱形，2～5叉状分枝；表面黄绿色、金黄色或黄棕色，有纵皱纹；节膨大，节上有分枝或枝痕。体轻，质脆，易折断，断面不平坦，皮部黄色，木部色较浅，射线放射状，髓部常偏向一边。叶对生于枝梢，易脱落，无柄；叶片呈长椭圆状披针形；先端钝圆，基部楔形，全缘；表面黄绿色，有细皱纹，主脉5出，中间3条明显；革质。气微，味微苦，嚼之有黏性。荆芥（B错）：【性状鉴别】药材茎方柱形，上部有分枝；表面淡黄绿色或淡紫红色，被短柔毛；体轻，质脆，断面类白色。叶对生，多已脱落，叶片3～5羽状分裂，裂片细长。穗状轮伞花序顶生。花冠多已脱落，宿萼钟形，顶端5齿裂，淡棕色或黄绿色，被短柔毛；小坚果4，矩圆状三棱形，棕黑色。气芳香，味微涩而辛凉。益母草（D错）：【性状鉴别】药材鲜益母草幼苗期无茎，基生叶圆心形，5～9浅裂，每裂片有2～3钝齿。花前期茎呈方柱形，上部多分枝，四面凹下成纵沟；表面青绿色；质鲜嫩，断面中部有髓。叶交互对生，有柄；叶片青绿色，质鲜嫩，揉之有汁；下部茎生叶掌状3裂，上部叶羽状深裂或浅裂成3片，裂片全缘或具少数锯齿。气微，味微苦。金钱草（E错）：【性状鉴别】药材常缠结成团，无毛或被疏柔毛。茎扭曲，表面棕色或暗棕红色，有纵纹，下部茎节上有时具须根，断面实心。叶对生，多皱缩，展平后呈宽卵形或心形，基部微凹，全缘；上表面灰绿色或棕褐色，下表面色较浅，主脉明显突起，用水浸后，对光透视可见黑色或褐色条纹。有的带花，花黄色，单生叶腋，具长梗。蒴果球形。气微，味淡。